女，36岁，发热，面色苍白，伴牙龈出血一周入院。入院次日起出现皮肤多处片状瘀斑血尿。血红蛋白80g/L，白细胞2.0×10⁹/L，血小板50×10⁹/L，血浆纤维蛋白原0.8g/L。骨髓检查：有核细胞增生极度活跃，细胞浆颗粒粗大的早幼粒细胞占85%。首选的治疗方案应为
A. 小剂量阿糖胞苷
B. 柔红霉素加阿糖胞苷
C. DA方案+小剂量肝素
D. 高三尖杉酯碱加阿糖胞苷
E. 全反式维甲酸+肝素

正确答案：E。全反式维甲酸+肝素

解析：患者诊断为急性早幼粒细胞白血病，治疗应首选全反式维甲酸，因患者出现DIC，需要抗凝治疗，应加用肝素，故治疗方案首选全反式维甲酸+肝素（E对）。小剂量阿糖胞苷（A错）可用于治疗成人急性粒细胞白血病或单核细胞白血病；柔红霉素加阿糖胞苷（B错）、DA方案+小剂量肝素（C错）、高三尖杉酯碱加阿糖胞苷（D错）均是AML（非早幼粒细胞白血病）的诱导治疗方案。